呈棒状，上粗下细，略弯曲，表面黄白色或绿白色，密被短柔毛，花萼绿色，先端5裂的饮片是
A. 辛夷
B. 金银花
C. 槐花
D. 洋金花
E. 款冬花

正确答案：B。金银花

解析：本题考查的是金银花药材的性状特征。呈棒状，上粗下细，略弯曲，表面黄白色或绿白色，密被短柔毛，花萼绿色，先端5裂的饮片是金银花（B对）。金银花：【性状鉴别】药材呈棒状，上粗下细，略弯曲。表面黄白色或绿白色（贮久色渐深），密被短柔毛。偶见叶状苞片。花萼绿色，先端5裂，裂片有毛。开放者，花冠筒状，先端二唇形。气清香，味淡，微苦。辛夷（A错）：【性状鉴别】药材望春花呈长卵形，似毛笔头。基部常具短梗，梗上有类白色点状皮孔。苞片外表面密被灰白色或灰绿色有光泽的长茸毛，内表面类棕色，无毛。体轻，质脆。气芳香，味辛凉而稍苦。槐花（C错）：【性状鉴别】药材皱缩而卷曲，花瓣多散落。完整者花萼钟状，黄绿色，先端5浅裂，花瓣5，黄色或黄白色，近圆形，先端微凹。雄蕊10，其中9个基部连合，花丝细长。雌蕊圆柱形，弯曲。体轻。气微，味微苦。洋金花（D错）：【性状鉴别】药材多皱缩成条状，花萼呈筒状，灰绿色或灰黄色，先端5裂，表面微具毛绒；花冠呈喇叭状，淡黄色或黄棕色，顶端5浅裂，两裂片之间微凹。烘干品质柔韧，气特异；晒干品质脆，气微，味微苦。款冬花（E错）：【性状鉴别】药材呈长圆棒状。上端较粗，下端渐细或带有短梗，外面被有多数鱼鳞状苞片，习称“连三朵”。苞片外表面紫红色或淡红色，内表面密被白色絮状茸毛。体轻，撕开后可见白色茸毛。气清香，味微苦而辛。